除极阻滞是指
A. 低钾血症时的神经－肌肉兴奋性↓
B. 高钾血症时的神经－肌肉兴奋性↓
C. 低钾血症时的神经－肌肉兴奋性↑
D. 高钾血症时的神经－肌肉兴奋性↑
E. 低钙血症时的神经－肌肉兴奋性↑

正确答案：B。高钾血症时的神经－肌肉兴奋性↓

解析：除极阻滞是指重度高钾血症时肌肉细胞膜上的快钠通道失活，细胞处于去极化阻滞状态而不能兴奋（B对）。轻度高钾血症时细胞兴奋性增高（D错）是由静息期细胞内钾外流减少引起。Ca2＋维持神经-肌肉的兴奋性，当血浆Ca2＋的浓度降低时，神经-肌肉的兴奋性增高（E错）。低钾血症时细胞处于超极化阻滞状态（AC错），细胞兴奋性降低。